保障医务人员最简单、最经济的措施是
A. 正确佩戴手套
B. 正确佩戴口罩
C. 正确佩戴防护眼镜和面罩
D. 正确穿戴工作服和工作帽
E. 手卫生

正确答案：E。手卫生

解析：手卫生是预防和控制医院感染、保障患者和医务人员安全最重要、最简单、最经济的措施。掌握“患者、医务人员及环境的防护”知识点。